某女，40岁。素患肝火上升之头晕目赤，近日又患痰火郁结之瘰疬。治当清肝、明目、散结消肿，宜选用的药是
A. 熊胆
B. 秦皮
C. 夏枯草
D. 谷精草
E. 青葙子

正确答案：C。夏枯草

解析：本题考查的是夏枯草的功效。素患肝火上升之头晕目赤，近日又患痰火郁结之瘰疬。治当清肝、明目、散结消肿，宜选用的药是夏枯草（C对）。夏枯草：【功效】清肝明日，散结消肿。秦皮（B错）：【功效】清热解毒，燥湿止带，清肝明目。谷精草（D错）：【功效】疏散风热，明目退翳。青葙子（E错）：【功效】清肝泻火，明目退翳。熊胆（A错）的应用，2022年考试指南未明确说明。熊胆：【功效】清热解毒，明目，止痉。